髀枢至膝中的骨度分寸是
A. 14 寸
B. 15寸
C. 16寸
D. 18寸
E. 19寸

正确答案：E。19寸

解析：髀枢即股骨大转子至膝中即腘横纹的分寸是19寸（E对）。臀沟至腘横纹相当于14寸（A错）。印堂至后发际正中为15寸（B错）。腘横纹至外踝尖为16寸（C错）。耻骨联合上缘至股骨内上髁上缘为18寸（D错）。